急性胰腺炎肝郁气滞证的治法是
A. 清肝利胆，泄浊畅中
B. 疏肝利胆，行气止痛
C. 通腑泄热，行气止痛
D. 疏肝解郁，益气健脾
E. 活血化瘀，行气止痛

正确答案：B。疏肝利胆，行气止痛

解析：清肝利胆，泄浊畅中，可针对于素有肝胆疾患，湿热内蕴；或嗜食肥甘厚味，损伤脾胃，生湿蕴热，湿热熏蒸，肝胆疏泄不利等（A错）。清肝利胆针对肝郁气滞一词，郁和滞都是气机运行不利引起的，针对此要行要疏，小柴胡汤可疏肝利胆，行气止痛（B对）。通腑泄热，行气止痛多见于全腹疼痛，痛而拒按，发热，口苦而干，脘腹胀满，大便秘结，小便短黄，舌质红，苔黄腻，脉沉实或滑数，为大承气汤证（C错）。疏肝解郁益气健脾针对于肝郁气虚证（D错）。活血化瘀，行气止痛主治胸中瘀血证（E错）。